常2～3个花序连在一起，苞片外表面紫红色或淡红色，内表面密被白色絮状茸毛的中药材是
A. 金银花
B. 辛夷
C. 洋金花
D. 款冬花
E. 西红花

正确答案：D。款冬花

解析：本题考查的是款冬花药材的性状鉴别。常2～3个花序连在一起，苞片外表面紫红色或淡红色，内表面密被白色絮状茸毛的中药材是款冬花（D对）。款冬花：【性状鉴别】药材呈长圆棒状。常单生或2～3个基部连生。上端较粗，下端渐细或带有短梗，外面被有多数鱼鳞状苞片，习称“连三朵”。苞片外表面紫红色或淡红色，内表面密被白色絮状茸毛。体轻，撕开后可见白色茸毛。气清香，味微苦而辛。金银花（A错）：【性状鉴别】药材呈棒状，上粗下细，略弯曲。表面黄白色或绿白色（贮久色渐深），密被短柔毛。偶见叶状苞片。花萼绿色，先端5裂，裂片有毛。开放者，花冠筒状，先端二唇形。气清香，味淡，微苦。辛夷（B错）：【性状鉴别】药材望春花呈长卵形，似毛笔头。基部常具短梗，梗上有类白色点状皮孔。苞片外表面密被灰白色或灰绿色有光泽的长茸毛，内表面类棕色，无毛。体轻，质脆。气芳香，味辛凉而稍苦。洋金花（C错）：【性状鉴别】药材多皱缩成条状，花萼呈筒状，灰绿色或灰黄色，先端5裂，表面微具毛绒；花冠呈喇叭状，淡黄色或黄棕色，顶端5浅裂，两裂片之间微凹。烘干品质柔韧，气特异；晒干品质脆，气微，味微苦。西红花（E错）：【性状鉴别】药材呈线形，三分枝。暗红色，上部较宽而略扁平，顶端边缘显不整齐的齿状，内侧有一短裂隙，下端有时残留一小段黄色花柱。体轻，质松软，无油润光泽。干燥后质脆易断。气特异，微有刺激性，味微苦。取本品浸于水中，可见橙黄色呈直线下降，并逐渐扩散，水被染成黄色，无沉淀。柱头呈喇叭状，有短缝；在短时间内，用针拨之不破碎。